患儿，男，5岁。周身散在猩红色皮疹5天，低热，咽部有糜烂疼痛，唇口干燥，或伴有干咳，食欲不振，舌红少津苔剥脱，脉细数。其治法是
A. 辛凉宣肺，清热利咽
B. 清气凉营，泻火解毒
C. 养阴生津，清热润喉
D. 清热解毒，利咽消肿
E. 清热解毒，佐以透发

正确答案：C。养阴生津，清热润喉

解析：猩红热是由A组乙型溶血性链球菌感染后引起的急性发疹性呼吸道传染病，临床以发热、咽峡炎、全身弥漫性猩红色皮疹和疹退后皮肤脱屑为主要特征，本病例临床特点与之相符，故诊断为猩红热。根据”低热，咽部有糜烂疼痛，唇口干燥，或伴有干咳，舌红少津苔剥脱，脉细数“，可诊断为阴虚失润，虚火上炎咽喉，故当治以养阴生津，清热润喉（C对），宜选沙参麦冬汤加味。辛凉宣肺，清热利咽（A错），是猩红热之邪侵肺卫证的治法。清气凉营，泻火解毒（B错），是猩红热之毒炽气营证的治法。清热解毒，利咽消肿（D错），是是麻疹之麻毒攻喉的治法。清热解毒，佐以透发（E错），是麻疹之邪入肺胃证的治法。